某男，49岁。症见大便脓血、里急后重、发热腹痛。医师处以香连丸，处方组成：萸黄连800g、木香200g。以上二味，粉碎成细粉，过筛，混匀，每100g粉末用米醋8g，加适量的水泛丸，干燥，即得。《中国药典》规定，香连丸的溶散时限是
A. 15分钟
B. 30分钟
C. 1小时
D. 45分钟
E. 2小时

正确答案：C。1小时

解析：本题考查的是丸剂的溶散时限。《中国药典》规定，香连丸的溶散时限是1小时（C对）。溶散时限除另有规定外，小蜜丸、水蜜丸和水丸应在1小时内全部溶散；浓缩丸和糊丸应在2小时（E错）内全部溶散；滴丸应在30分钟（B错）内全部溶散，包衣滴丸应在1小时内全部溶散。除另有规定外，大蜜丸及研碎、嚼碎后或用开水、黄酒等分散后服用的丸剂不检查溶散时限。